沉香的原植物属于
A. 木犀科
B. 茜草科
C. 豆科
D. 五加科
E. 瑞香科

正确答案：E。瑞香科

解析：本题考查的是沉香的来源。沉香的原植物属于瑞香科（E对）。沉香：【来源】为瑞香科植物白木香含有树脂的木材。来源于木犀科（A错）的中药有秦皮、连翘、女贞子等。来源于茜草科（B错）的中药有巴戟天、茜草、钩藤、栀子、白花蛇舌草等。来源于豆科植物（C错）的中药有葛根、甘草、黄芪、鸡血藤、降香、合欢皮、番泻叶、槐花等。来源于五加科（D错）中药有人参、红参、三七、通草等。